某男，50岁。感冒数日，症见寒热往来、胸胖苦满、食欲不振、心烦喜呕、口苦咽干，中医诊断为外感病邪犯少阳证。治当解表散热，疏肝和胃。处以小柴胡汤，其药物组成为柴胡、黄芪、党参、大枣、生姜、姜半夏、甘草。处方中，甘草的主要含量测定成分之一为甘草酸，其结构类型是
A. 强心苷
B. 皂苷
C. 生物碱
D. 多糖
E. 黄酮

正确答案：B。皂苷

解析：本题考查的是甘草的质量控制成分。处方中，甘草的主要含量测定成分之一为甘草酸，其结构类型是皂苷（B对）。甘草所含的三萜皂苷以甘草皂苷含量最高。甘草皂苷又称甘草酸，为甘草中的甜味成分。《中国药典》以甘草苷和甘草酸为指标成分，控制甘草和炙甘草的质量，其中甘草苷为黄酮苷，并要求甘草和炙甘草的甘草苷含量均不得少于0.50%，甘草中甘草酸的含量不得少于2.0%，炙甘草中甘草酸的含量不得少于1.0%。强心苷（A错）、生物碱（C错）、多糖（D错）与黄酮（E错），不是甘草的含量测定成分。